关于胫骨结节骨软骨病的治疗不宜采用的方法是
A. 减少膝关节剧烈活动以缓解症状
B. 症状明显时可行膝关节短期制动
C. 局部封闭
D. 成年后仍有症状可行钻孔或植骨术
E. 可使用止痛药

正确答案：C。局部封闭

解析：胫骨结节骨软骨病常见于12～14岁好动男孩，多为单侧性。局部封闭（C错，为本题正确选项）指在病变部位局部注射糖皮质激素进行治疗，对腰肌劳损、骨关节炎早期患者等效果较好，不适用于胫骨结节骨软骨病的治疗。本病在18岁后胫骨结节与胫骨上端骨化后，症状即自行消失，但局部隆起不会改变。在18岁前，只要减少膝关节剧烈活动症状可自行缓解（A对）。可使用止痛药（E对），有明显疼痛者，可辅以理疗或膝关节短期制动（B对）。偶有成年后尚有小块碎裂骨骺未与胫骨结节融合而症状持续者，此时可行钻孔或植骨术以促进融合（D对）。